男孩，1岁。发热伴咳嗽、气促7天。自出生后喂养困难，生长发育落后，多次患肺炎，查体：T38℃，P120次/分，R50次/分。消瘦，呼吸急促，双肺可闻及细湿啰音，胸骨左缘上方闻及粗糙响亮的收缩期杂音。腹软，肝肋下3cm，质中，脾肋下未触及，手指甲床可见毛细血管搏动。该患儿目前最易发生的并发症是
A. 血栓形成
B. 生长落后
C. 充血性心力衰竭
D. 营养不良
E. 肺动脉瘤样扩张

正确答案：C。充血性心力衰竭

解析：血栓形成、生长落后、充血性心力衰竭、营养不良、肺动脉瘤样扩张这些并发症都可以发生在动脉导管未闭型先心病中，但该患儿在动脉导管未闭的基础上还有咳嗽、气促、肺炎、双肺可闻及细湿啰音的症状，这是由于左心衰而出现的典型症状，因此，该患儿最可能并发了充血性心力衰竭（C对）。假如并发了血栓，一定会有血栓部位的相关表现，该患儿并没有血栓的表现和前兆（A错）。生长落后（B错）和营养不良（D错）是患儿自出生后喂养困难的结果，不是动脉导管未闭的并发症。肺动脉瘤样扩张是支气管扩张的体征，支气管扩张常发生在青年人当中，小儿很少见（E错）。